医疗机构保存住院病历的最低期限是
A. 30年
B. 15年
C. 20年
D. 50年
E. 10年

正确答案：A。30年

解析：医疗机构保存住院病历的最低期限是30年（A对CDE错），门诊病历的保存最低期限是15年（B错）。